关于上颌中切牙下列哪项是错误的
A. 唇侧牙槽骨壁薄
B. 单根弯向远中，断面呈三角形
C. 可使用唇腭侧摇动力
D. 应用旋转力效果好
E. 最后沿牙根纵轴方向牵引脱位

正确答案：B。单根弯向远中，断面呈三角形

解析：本题考查各类牙拔除术-上颌切牙。关于上颌中切牙错误的是单根弯向远中，断面呈三角形（B错，为本题正确答案）。上颌中切牙牙根较直，呈圆锥形单根，而不是三角形；唇侧牙槽骨弹性较腭侧大且壁薄（A对）。此牙牙根是圆锥形单根，拔除时应用用旋转力效果好（D对），可撕裂牙周膜、扩大牙槽窝；同时配合适合使用摇动力，摇动次序是先向弹性大、阻力小、牙槽骨比较薄的一侧进行，故拔除此牙时可使用唇腭侧摇动力（C对）；在牙齿有一定程度松动后开始牵引，继续配合扭转、摇动，最后顺势力导沿牙根纵轴方向牵引脱位（E对）即可拔出。